慢性肺淤血可引起的脏器改变是
A. 直肠息肉形成
B. 脾脏白色锥形病灶
C. 回盲部肠腔狭窄
D. 胃壁溃疡形成
E. 肝脏肿大

正确答案：E。肝脏肿大

解析：慢性肺淤血时，肺泡壁毛细血管扩张充血，肺泡间隔变厚、纤维化，肺质地变硬，并逐渐形成肺动脉高压，引起右心衰竭，静脉回流障碍最终导致肝脏肿大（E对）。直肠息肉形成（A错）、脾脏白色锥形病灶（B错）、回盲部肠腔狭窄（C错）和胃壁溃疡形成（D错）均与慢性肺淤血无关。